流脑主要传播途径是
A. 空气传播
B. 经水传播
C. 经食物传播
D. 日常生活间接接触传播
E. 密切接触直接传播

正确答案：A。空气传播